营养左心室前壁的是
A. 左冠状动脉
B. 右冠状动脉
C. 心大静脉
D. 心小静脉
E. 心最小静脉

正确答案：A。左冠状动脉

解析：左冠状动脉（A对）发出对角支营养左心室前壁，粗大者也可至前乳头肌。